形寒，肢冷，舌淡，属于
A. 阳偏衰
B. 阴偏衰
C. 阴阳互损
D. 阴寒偏盛
E. 热盛伤阴

正确答案：D。阴寒偏盛